男，38岁。1年来活动后气促，伴腹胀及双下肢水肿。自述既往无不适，生活工作正常。查体：BP100/60mmHg，颈静脉怒张，双肺底可闻及湿性啰音，心界向两侧扩大，S₁减弱，心尖部可闻及3/6级收缩期杂音，肝肋下3cm，双下肢凹陷性水肿。该患者最可能的诊断是
A. 扩张性心肌病
B. 风湿性心脏病
C. 缩窄性心包炎
D. 冠心病
E. 肥厚型心肌病

正确答案：A。扩张性心肌病

解析：患者中年男性，活动后气促，双肺底可闻及湿性啰音（提示左心衰竭），颈静脉怒张，肝肋下3cm（提示肝淤血肿大），双下肢凹陷性水肿（提示右心衰竭），心尖部可闻及3/6级收缩期杂音（提示左心室扩大导致的相对性二尖瓣关闭不全），心界向两侧扩大（扩张型心肌病典型体征），综合患者的病史、临床表现和体格检查，该患者最可能的诊断是扩张型心肌病（A对）。风湿性心脏病（B错）患者多有风湿热病史，且多在年幼时发病，并伴有相应瓣膜区的改变。缩窄性心包炎（C错）主要特征为心包增厚和室间隔抖动征，一般不会出现心界向两侧扩大等体征。冠心病（D错）典型表现为与劳力、运动相关的心绞痛等心肌缺血症状。肥厚型心肌病（P266）（E错）心界一般不大或仅左室增大，主要特征为心室不对称肥厚而无心室腔增大，典型杂音为胸骨左缘第3～4肋间较粗糙的喷射性收缩期杂音。